下列属于舌骨上肌群的是
A. 二腹肌
B. 下颌舌骨肌
C. 颏舌骨肌
D. 茎突舌骨肌
E. 以上都是

正确答案：E。以上都是

解析：舌骨上肌群：包括二腹肌、下颌舌骨肌、颏舌骨肌和茎突舌骨肌。掌握“咀嚼肌、颈部肌及口颌系统肌链”知识点。